医疗机构应对无正当理由开具抗菌药物超常处方达到一定次数的医师提出警告，应当予以警告的最低次数是
A. 2次
B. 6次
C. 3次
D. 4次
E. 5次

正确答案：C。3次

解析：医疗机构应对无正当理由开具抗菌药物超常处方达到3次（C对）以上且无正当理由的医师提出警告，限制其特殊使用级和限制级抗菌药物处方权。